有利胆作用，但禁用于胆道完全梗阻患者的药物是
A. 美沙拉嗪
B. 熊去氧胆酸
C. 洛哌丁胺
D. 柳氮磺吡啶
E. 匹维溴铵

正确答案：B。熊去氧胆酸

解析：本题考查胆石症与胆囊炎的用药注意事项与患者教育。熊去氧胆酸（B对）禁用于胆道完全梗阻和严重肝功能减退患者。